中药质量变异的常见现象有
A. 虫蛀
B. 霉变
C. 潮解
D. 腐烂
E. 气味散失

正确答案：A、B、C、D、E。虫蛀；霉变；潮解；腐烂；气味散失

解析：本题考查的是中药饮片贮存常见的质量变异现象。中药质量变异的常见现象有.虫蛀（A对）、霉变（B对）、潮解（C对）、腐烂（D对）与气味散失（E对）。中药饮片的贮存保管是否妥当，直接影响着饮片的质量、临床疗效及患者安危。因此，做好中药饮片的贮存养护工作至关重要。中药饮片在贮存中由于储存条件不当，使药物的颜色、气味、形态、内部组织等出现各种各样的变异。常见的变异现象大致可分为以下几种：1.虫蛀；2.霉变；3.泛油；4.变色；5.气味散失；6.风化；7.潮解；8.粘连；9.腐烂。